女，27岁，已婚。停经9周，阵发性下腹痛3天，阴道少量流血2天。为判断是否能继续妊娠，首选的辅助检查时
A. 尿妊娠试验
B. B超检查
C. 胎心监测
D. 胎盘功能检查
E. 监测血孕酮

正确答案：B。B超检查

解析：27岁已婚女性，停经9周（早期流产发生于12周前），阵发性下腹痛3天，阴道少量流血2天（先兆流产主要表现为停经后阴道少量流血和阵发性腹痛），应考虑为先兆流产，为判断是否能继续妊娠，首选的辅助检查是B型超声检查（B对）。B型超声检查可以根据妊娠囊的形态，有无胎心搏动，确定胚胎或胎儿是否存活，以判断是否能继续妊娠。监测血孕酮（P49）（E错）可用于协助判断先兆流产的预后，但不如B超检查直接准确。尿妊娠试验（P42）（A错）主要用于早早孕诊断。胎心监测（C错）和胎盘功能检查（D错）主要用于胎儿健康状况评估。